某儿童8岁，在智力测验中得分为100，则其智商（IQ）为
A. 超常
B. 优秀
C. 平常
D. 不能判断
E. 以上都不对

正确答案：C。平常